临产后正常宫缩起自
A. 两侧宫角部
B. 两侧子宫侧壁
C. 宫颈部
D. 子宫下段
E. 宫底部

正确答案：A。两侧宫角部

解析：临产后正常宫缩起自两侧宫角部（A对）以微波形式向宫腔中线集中，左右对称。